一伤寒患者经治疗后体温渐降，但未降至正常，此后体温再次升高，血培养阳性，属于
A. 复发
B. 再燃
C. 重复感染
D. 混合感染
E. 再感染

正确答案：B。再燃

解析：伤寒再燃指部分伤寒患者在缓解期，体温还未下降到正常，即再度升高，持续5～7天后退热，血培养也常阳性。本例患者经治疗后体温渐降，但未降至正常，此后体温再次升高，血培养阳性属于伤寒再燃（B对）。其发生机理与复发相同，即与伤寒杆菌菌血症尚未得到完全控制有关。有效和足量的抗菌药物治疗可减少或杜绝再燃。伤寒复发（A错）是指患者在退热1～3周后，体温再度升高，临床症状再次出现，血培养阳性，称为复发，多见于抗菌治疗不彻底的患者，病灶内的伤寒杆菌没有完全清除，潜伏在单核-巨噬细胞系统中的细菌大量繁殖，再次侵入血流所致。复发者病情多较轻，病程短，并发症少。个别患者可复发多次。重复感染（C错）是指被某种病原体感染的患者再次感染同一种病原体，多见于疟疾、血吸虫病、钩虫病等。混合感染（D错）是指两种或两种以上病原体同时感染人体，临床较少见；再感染（E错）指同一传染病在完全痊愈后，经过长短不等的间隙再度感染。